在《中国药典》中，使用高效液相色谱法作为含量测定方法的药物是
A. 盐酸四环素
B. 地西泮
C. 硝苯地平
D. 异烟肼
E. 硫酸庆大霉素

正确答案：A。盐酸四环素